以下为生理性止血首先发生的生理过程是
A. 受损小血管收缩
B. 血小板聚集
C. 血小板血栓形成
D. 血凝块形成
E. 局部形成纤维蛋白

正确答案：A。受损小血管收缩